美国药典的缩写是
A. BP
B. USP
C. ChP
D. EP
E. JP

正确答案：B。USP

解析：本题考查药典。美国药典的缩写是USP（B对）。USP为《美国药典》的缩写；BP（A错）为《英国药典》的缩写； ChP（C错）为《中国药典》的缩写；EP（D错）为《欧洲药典》的缩写；JP（E错）为《日本药局方》的缩写。